患者，男，56岁，咳嗽、咳痰、发热1月余。入院查体：T37.3C，P99次/分，R22次/分，BP123/85mmHg；双肺未闻及明显干、湿性啰音。检查结果：WBC8.06×10⁹/L，N%76.7%，CRP49.06mg/L；肝肾功能正常。肺部CT显示：右肺上叶散在斑片状浸润影。痰涂片可见结核分枝杆菌。诊断为肺结核。关于肺结核的抗结核化学治疗基本原则的说法，错误的是
A. 早期
B. 规律
C. 负荷量
D. 联合
E. 全程

正确答案：C。负荷量

解析：本题考查肺结核的治疗原则。不属于抗结核化学治疗基本原则的是负荷量（C错，为本题正确答案）。结核病化学治疗的基本原则是“早期（A对）、规律（B对）、全程（E对）、适量、联合（D对）”。整个治疗方案分为强化期和巩固期两个阶段。化学治疗的主要作用为杀菌和灭菌、防止耐药菌产生、减少结核菌的传播。